在小儿疾病中,中医学认为最易受到侵犯的是
A. 心肝
B. 脾肝
C. 肺脾
D. 脾肾
E. 心肾

正确答案：C。肺脾

解析：小儿肺脏娇嫩、卫表未固，易为邪气所感，使肺系疾病成为儿科发病率最高的一类疾病。小儿“脾常不足”，其脾胃之体成而未全、脾胃之气全而未壮，因而易于因家长喂养不当、小儿饮食失节，出现受纳、腐熟、精微化生转输等方面的异常，使脾系疾病的发病率在儿科仅次于肺系病证而居第二位（C对）。